哪一个不属于突发事件的类型
A. 气象灾害
B. 生物灾害
C. 社会安全事件
D. 食物中毒
E. 肺癌晚期死亡

正确答案：E。肺癌晚期死亡

解析：本题考查突发事件的类型。突发事件包括自然灾害、事故灾难、社会安全事件（C对）和公共卫生事件。其中自然灾害包括水旱灾害、气象灾害（A对）、地震灾害、地质灾害、海洋灾害、生物灾害（B对）和森林草原火灾等。公共卫生事件包括重大传染病疫情、重大动植物疫情、食品安全与职业危害（食物中毒（D对）等）等。肺癌晚期死亡（E错，为本题正确答案）不属于突发事件。